下列除哪项外，均是厥证的病因
A. 情志内伤
B. 体虚劳倦
C. 亡血失津
D. 饮食不节
E. 感受暑热

正确答案：E。感受暑热

解析：七情内伤，气逆为病，可致厥证，其中因怒致厥者最多（A对）。体虚劳倦者，元气素虚，加之劳累饥饿，致中气不足，脑海失养，或睡眠长期不足，阴阳气血亏耗，而致厥证（B对）。亡血失津多致气随血脱，阳随阴消，神明无主而致厥证（C对）。饮食不节致脾胃受损，运化失常，聚湿生痰，痰浊阻滞，气机不畅，日久痰愈多而气愈阻，气愈滞则痰更盛，若痰浊上壅，清阳被阻，可致厥证（D对）。感受暑热之邪可致暑厥，但内科厥证是以内伤杂病中具有突然发生的一时性昏倒不知人事为主症，伴有四肢逆冷的病证，暑厥为感受外邪而致，不在此范畴（E错，为本题正确答案）。